患者，女性，35岁，某大学教师，3个月前因出国问题与领导争吵，而后逐渐表现出情绪低落、兴趣减退，对未来悲观失望，认为领导和同事都疏远她，常有怨天尤人的表现；能主动求医，接触良好。初次接触首选的手段是
A. 宣泄
B. 领悟
C. 强化控制
D. 增强自信心
E. 以上都不是

正确答案：A。宣泄